对于溺水儿童的急救处理方法不正确的是
A. 迅速消除口鼻污物
B. 立即恢复呼吸道通畅
C. 心脏复苏
D. 复苏后，就地进行进一步的抢救，不要搬运儿童
E. 口对口人工呼吸

正确答案：D。复苏后，就地进行进一步的抢救，不要搬运儿童

解析：本题考查溺水儿童的急救处理方法。溺水儿童就地抢救，立即恢复呼吸道通畅及心脏复苏，复苏后应立即送医院做进一步抢救和治疗（D错，为本题正确答案）溺水儿童的急救处理方法：1.迅速清除口鼻里污物（A对）：头朝下，撬开牙齿，清理干净口、鼻腔内的污物，再迅速的用手掌连击其肩后背部，立即恢复呼吸道通畅（B对）。2.倒出呼吸道内积水：抢救者单腿跪地，另一只腿屈起，把溺水的儿童俯卧放于屈起的大腿之上，让其头足呈下垂状态，然后颤抖大腿或压迫他的背部，倾出其呼吸道内的积水。3.吐出水后人工呼吸：如儿童呼吸及心跳微弱，立即进行口对口式人工呼吸（E对），同时配合进行胸外心脏复苏（C对）。